某女，因产后恶露不尽就诊，医师处方：当归12g、川芎9g、桃仁9g、灸甘草6g、炮姜6g、坤草15g。药师调剂时，坤草应付的是
A. 金钱草
B. 益母草
C. 龙胆草
D. 夏枯草
E. 豨莶草

正确答案：B。益母草

解析：本题考查的是常见饮片的正名和相关别名。药师调剂时，坤草应付的是益母草（B对）。益母草别名：坤草、茺蔚、益明。金钱草（A错）、龙胆草（C错）、夏枯草（D错）、豨莶草（E错）的别名，2022年考试指南未明确说明。